以下不是对急危重患者抢救工作中的道德要求的是
A. 树立时间就是生命的诊疗观
B. 在诊疗一般患者时，不能立即放弃去抢救生命危机的病人
C. 在诊疗行为上作出迅速快捷的反应，采取各项措施
D. 对患者的要求，耐心作出应答
E. 勤奋主动地做好治疗工作

正确答案：B。在诊疗一般患者时，不能立即放弃去抢救生命危机的病人